固位体应具备的条件为
A. 固位体应有良好的固位形和抗力形
B. 各固位体之间应能够取得固定桥所需的共同就位道
C. 固位体所用材料要达到一定的机械强度
D. 固位体应能够保护牙体组织
E. 以上均是

正确答案：E。以上均是

解析：本题考查固位体的一般设计原则。固位体的设计要满足固位和抗力的需求（A对），取得共同就位道能顺利带入（B对），选取合适材料加工（C对），恢复桥基牙形态和功能，发挥保护牙体组织健康（D对）、预防疾病的作用。综上，以上均是（E对，为本题正确答案）固位体应具备的条件。